急性牙周脓肿与急性牙槽脓肿的区别点包括
A. 有牙周袋
B. 多数牙髓有活力
C. 疼痛相对较轻
D. X线片示牙槽骨嵴有破坏，根尖周可正常
E. 以上均是

正确答案：E。以上均是

解析：本题考查牙周脓肿与牙槽脓肿的鉴别。牙周脓肿有牙周袋，牙槽脓肿没有牙周袋，可鉴别（A对）；牙周脓肿牙髓有活力，牙槽脓肿牙髓一般无活力，可鉴别（B对）；牙周脓肿疼痛程度相对较轻，牙槽脓肿疼痛较重，可鉴别（C对）；牙周脓肿牙槽嵴有破坏，可有骨下袋，牙槽脓肿根尖周可有骨质破坏，也可无，因此可通过X线鉴别（D对），（ABCD均对，故E对为本题的正确答案）。